某患儿脱落的乳牙上患有龋病。在龋病的切片上，观察到部分牙本质中出现裂隙及串珠样结构，这些表现应见于牙本质龋的
A. 坏死崩解层
B. 细菌侵入层
C. 脱矿层
D. 透明层
E. 脂肪变性层

正确答案：B。细菌侵入层

解析：牙本质龋损中的细菌侵入层：细菌侵入层位于脱矿层表面，细菌侵入小管并繁殖，有的小管被细菌所充满，小管扩张呈串珠状。掌握“牙本质，牙骨质龋”知识点。